绞窄性肠梗阻是指肠梗阻并伴有
A. 肠袢两端均完全阻塞
B. 肠壁血运障碍
C. 肠壁穿孔、坏死
D. 肠系膜扭转
E. 肠腔高度扩张

正确答案：B。肠壁血运障碍

解析：根据肠管有无血运障碍，可将肠梗阻分为单纯性和绞窄性两类。伴有血运障碍的肠梗阻称为绞窄性肠梗阻（B对），无血运障碍的肠梗阻称为单纯性肠梗阻。